下列关于舌咽神经痛的叙述中，不正确的是
A. 有反复发作史，复发无规律
B. 疼痛可分布在舌根
C. 疼痛可分布在咽部
D. 疼痛可分布在扁桃体
E. 睡眠时不会出现疼痛

正确答案：E。睡眠时不会出现疼痛

解析：本题考查舌咽神经痛的临床表现。下列关于舌咽神经痛的叙述中，不正确的是睡眠时不会出现疼痛（E错，为本题的正确答案）。舌咽神经痛的临床表现：好发于35～50岁，男性多见。阵发性剧痛位于扁桃体区（D对）、咽部（C对）、舌根部（B对）、颈深部、耳道深部及下颌后区等处。虽然每个患者的疼痛部位不尽相同，但一般不超出上述范围。疼痛呈间歇性发作，昼夜均有阵痛，通常是早晨或上午频繁，下午或傍晚逐渐减少。可在睡眠时发作，此点与三叉神经痛不同。每次发作持续数秒至数分钟，性质为针刺样、刀割样、烧灼样、电击样阵发性剧痛，也可表现为痛性抽搐。疼痛多位于一侧，开始于舌根部或扁桃体区，并向耳部放射。由于发作时患者咽喉部有梗塞感或异物感，故常出现频繁咳嗽的现象。